引起慢性肾功能不全的最常见继发性肾脏病是
A. 乙肝相关性肾炎
B. 淀粉样变肾病
C. 糖尿病肾病
D. 良性肾小动脉硬化
E. 系统性红斑狼疮

正确答案：C。糖尿病肾病

解析：引起慢性肾功能不全的最常见继发性肾脏病是糖尿病肾病（C对），其他继发性肾脏病还有良性肾小动脉硬化（D错）、系统性红斑狼疮（E错）、淀粉样变肾病（B错）、乙肝相关性肾炎（A错）。引起慢性肾功能不全的最常见原发性肾脏病是慢性肾小球肾炎。